下列哪项属于一级预防内容
A. 普查
B. 筛检
C. 对人群进行免疫接种
D. 为预防遗传病儿的出生而终止妊娠
E. 用特效药物治疗疾病

正确答案：C。对人群进行免疫接种

解析：本题考查一级预防的措施。实现第一级预防可以采取多类措施，如预防环境中的有害暴露、提高机体抵抗力（如免疫接种（C对ABDE错））或保护个体免受有害暴露的伤害、教育个体改变危险行为等。